高温作业的主要类型有
A. 高温强辐射作业
B. 高温高湿作业
C. 夏季露天作业
D. 以上都不是
E. 以上都是

正确答案：E。以上都是

解析：本题考查高温作业的类型。高温作业指有高气温、或有强烈的热辐射、或伴有高气湿相结合的异常气象条件、WBGT指数超过规定限值的作业。高温作业按其气象条件的特点可分为下列三个基本类型：1.高温、强热辐射作业；2.高温、高湿作业；3.夏季露天作业（E对ABCD错）。